“壮水之主，以制阳光”适用于
A. 阴偏衰
B. 阳偏衰
C. 阴偏盛
D. 阳偏胜
E. 阴阳两虚

正确答案：A。阴偏衰

解析：阴偏衰，即阴虚，指机体阴液不足，凉润、宁静、抑制等功能减退，阴不制阳，出现虚热内生的病机变化。阴阴虚的病机特点为阴液不足，阴不制阳，阳气相对偏盛，临床表现为虚热证，可见五心烦热、骨蒸潮热、盗汗、咽干、颧红、舌红少苔、脉细数等，即所谓“阴虚则阳亢”“阴虚则热”。而治疗时多采用滋阴壮水，抑制阳亢火盛的治法（A对）。